以下对土壤污染的描述，哪一项是错误的
A. 土壤污染来源很复杂，有来自空气、水、废渣、垃圾、粪便等
B. 土壤污染物以间接影响人体为主，主要途径是土→植物→人，或土→水→人
C. 土壤污染物主要通过与人的直接接触而影响人体健康
D. 土壤污染物的性质很多样化，有化学性污染、物理性污染、生物性污染等
E. 土壤受重金属和农药的污染后，很难消除，污染期很长

正确答案：C。土壤污染物主要通过与人的直接接触而影响人体健康

解析：本题考查土壤污染的相关内容。土壤污染是指在人类生产和生活活动中排出的有害物质进入土壤中，超过一定限量，直接或间接地危害人畜健康的现象。土壤污染来源很复杂，有来自空气、水、废渣、垃圾、粪便等（A对）。土壤污染物的性质很多样化，有化学性污染、物理性污染、生物性污染等（D对）。土壤污染物以间接影响人体为主，主要途径是土→植物→人，或土→水→人（B对），而不是通过与人的直接接触而影响人体健康（C错，为本题正确答案）。土壤受重金属和农药的污染后，很难消除，污染期很长（E对）。